根据《关于加强乡村中医药技术人员自种自采自用中草药管理的通知》，乡村中医药技术人员可以自种自采自用的中草药是
A. 国家规定需纳入药食同源目录的中药材
B. 国家规定需特殊管理的医疗用毒性中草药
C. 国家规定需特殊管理的濒稀野生植物药材
D. 国家规定需特殊管理的麻醉药品原植物

正确答案：A。国家规定需纳入药食同源目录的中药材

解析：本题考查中药材自种、自采、自用的管理规定。乡村中医药技术人员不得自种自采自用下列中草药：①国家规定需特殊管理的医疗用毒性中草药（B对）；②国家规定需特殊管理的麻醉药品原植物（D对）；③国家规定需特殊管理的濒稀野生植物药材（C对）（A错，为本题正确答案）。